甲县肺癌粗死亡率比乙县高，经标准化后甲县肺癌标化死亡率比乙县低，最可能的原因是
A. 甲县的诊断水平比乙县高
B. 甲县的诊断水平比乙县低
C. 甲县的肿瘤防治工作比乙县差
D. 甲县的老年人在总人口中所占比重比乙县大
E. 甲县的老年人在总人口中所占比重比乙县小

正确答案：D。甲县的老年人在总人口中所占比重比乙县大